主要体现按五行学说确立抑强扶弱兼用治则的治法是
A. 抑木扶土法
B. 佐金平木法
C. 培土制水法
D. 泻南补北法
E. 以上都不是

正确答案：A。抑木扶土法

解析：“抑木扶土法”适用于木旺乘土或土虚木乘之证，临床应用时，应依据具体情况的不同而对抑木和扶土法有所侧重。如用于木旺乘土之证，则以抑木为主，扶土为辅；若用于土虚木乘之证，则应以扶土为主，抑木为辅。即“抑强扶弱兼用治则”（A对）。佐金平木法，是滋肺阴清肝火以治疗肝火犯肺病证的治法，也可称为“滋肺清肝法”，用于肺阴不足，右降不及的肝火犯肺证（B错）。培土制水法，是健脾利水以治疗水湿停聚病证的治法，适用于脾虚不运，水湿泛滥而致水肿胀满之证（C错）。泻南补北法，是泻心火补肾水以治疗心肾不交病证的治法，适用于肾阴不足，心火偏旺，水火不济，心肾不交之证（DE错）。